氧化苦参碱具有
A. 水溶性
B. 很强的毒性
C. 明显的治疗艾滋病作用
D. 解痉镇痛作用
E. 镇咳作用

正确答案：A。水溶性

解析：本题考查的是氧化苦参碱的性质。氧化苦参碱具有水溶性（A对）。氧化苦参碱是苦参碱的N-氧化物，具半极性配位键，其亲水性比苦参碱更强，易溶于水，可溶于三氯甲烷，但难溶于乙醚。具有很强的毒性（B错）的是乌头碱。乌头碱类化合物有剧毒，用之不当易致中毒，且毒性较强，0.2mg即可中毒，2～4mg即可致人死亡。具有解痉镇痛作用（D错）的是莨菪碱。莨菪碱及其外消旋体阿托品有解痉镇痛、解有机磷中毒和散瞳作用。具有镇咳作用（E错）的是麻黄碱。麻黄水煎液、麻黄醇提取物、麻黄生物碱、麻黄碱均具有平喘、镇咳作用。具有明显的治疗艾滋病作用（C错）的生物碱，2022年考试指南未明确说明。